下列各项，具有统血功能的是
A. 肾
B. 肺
C. 肝
D. 心
E. 脾

正确答案：E。脾

解析：统血的功能是气的固摄作用的体现，脾气是一身之气分布到脾脏的部分，一身之气充足，则脾气充盛，脾气健旺，气生有源，气足而固摄作用健强，血液则循脉运行而不逸出脉外（E对）；肾的主要生理功能是主藏精，主水，主纳气，与血液运行无太大关联（A错）。肺，主一身之气，朝百脉，主治节，具有助心行血的功能，使血液正常运行，不具备统血的功能 （B错）；肝主藏血，指肝具有贮藏血液、调节血量和防止出血的机能，不具备统血功能（C错）；心主血脉，有两方面的含义，一是行血，二是生血，不具备统血的功能（D错）。